中医养生学认为，探索衰老机制的中心环节是
A. 肾中精气的盛衰
B. 心肺的功能状态
C. 脾胃运化功能有强弱
D. 肝肾精血互化
E. 肾中精气的盛衰和脾胃的功能状态

正确答案：E。肾中精气的盛衰和脾胃的功能状态

解析：中医养生的基本原则是顺应自然、形神兼具、保精护肾和调理脾胃，首要目的是培补人体正气，增强抗病能力，减少和防止疾病的发生；养生的更高目的是协调人体阴阳，使身心处于一个最佳状态，从而延缓衰老、延长寿命。肾为先天之本，脾胃为气血生化之源，为后天之本，养生从这两个方面既可以达到抗衰老的目的。（E对）。